确诊子宫内膜异位症最有效的检查方法是
A. 腹腔镜检查
B. 诊断性刮宫
C. B型超声波检查
D. 宫腔镜检查
E. 子宫输卵管碘油造影

正确答案：A。腹腔镜检查

解析：腹腔镜检查（A对）是诊断子宫内膜异位症的最佳方法。在腹腔镜下活检可确诊，并确定临床分期。B型超声检查（C错）可确定卵巢异位囊肿的位置、大小和形状。但此回声图像无特异性，不能单纯根据B超确诊。诊断性刮宫（B错）作用是止血和明确子宫内膜病理诊断，非子宫内膜异位症的检查方法。宫腔镜检查（D错）仅直视宫腔内情况，不能确诊宫腔外的子宫内膜异位。子宫输卵管碘油造影（E错）多用于诊断子宫-输卵管不通。